男性，18岁。反复喘息发作2年，常在春季发病，表现为突然发作呼吸困难，每次发作1～2小时，经咳出白色黏痰后症状缓解，血象检查：嗜酸性粒细胞増多，IgE增高，X线胸片正常，应诊断为
A. 支气管哮喘
B. 急性左心衰竭
C. 急性间质性肺炎
D. 复发性多软骨炎
E. 慢性支气管炎

正确答案：A。支气管哮喘

解析：青年男性，反复喘息发作2年，常在春季发病，表现为突然发作性呼吸困难，经咳出白色黏痰后症状缓解（为支气管哮喘的典型症状），血象检查：嗜酸性粒细胞増多，IgE增高，X线胸片正常等符合支气管哮喘的临床表现以及辅助检查，故应诊断为支气管哮喘（A对）。急性左心衰竭（P174-P175）（B错）的患者多有高血压、冠状动脉粥样硬化性心脏病等病史，表现为突发气急，端坐呼吸，阵发性咳嗽，常咳出粉红色泡沫痰，两肺可闻及广泛的湿啰音和哮鸣音，胸部X线检查可见心脏扩大、肺淤血征。急性间质性肺炎（C错）的患者多有进行性加重的呼吸困难以及影像学上的双肺弥漫性病变。复发性多软骨炎（D错）是一类少见的累及全身多系统疾病，具有反复发作和缓解的进展性炎破坏性病变，累及软骨和其他全身结缔组织，X线检查可有肺不张及肺炎。慢性支气管炎（E错）是气管、支气管黏膜及其周围组织的慢性非特异性炎症，临床上以咳嗽、咳痰为主要症状，或有喘息，每年发病持续3个月或更长时间，连续2年或2年以上，X线检查可有肺纹理增粗、紊乱，呈网状或条索状、斑点状阴影，血常规偶可见白细胞总数和（或）中性粒细胞增高。